一患者颏部被钝器打击后，出现双侧后牙早接触，前牙开（牙合），双侧颞下颌关节区肿胀疼痛，你认为是
A. 双侧颞颌关节急性前脱位
B. 双侧髁状突颈骨折
C. 双侧升颌肌群痉挛
D. 双侧关节盘穿孔破裂
E. 双侧翼外肌痉挛

正确答案：B。双侧髁状突颈骨折

解析：本题考查双侧髁状突颈骨折的临床表现。双侧髁突颈部骨折（B对）时，由于升颌肌群的牵拉，下颌支向后上方移动，导致双侧后牙早接触，前牙开（牙合），双侧颞下颌关节区肿胀疼痛。双侧颞颌关节急性前脱位（A错）表现为下颌运动异常，患者呈开口状，不能闭口，唾液外流，下颌前伸，两颊变平，髁突脱位，耳屏前方触诊有凹陷，在颧弓下可触到脱位的髁突。双侧升颌肌群痉挛（C错）表现为不自主肌肉抽搐、肌痛和严重的开口受限，不少患者还伴有头痛。双侧关节盘穿孔破裂（D错）表现为开闭口、前伸、侧方运动的任何阶段有多声破碎音，开口型歪曲。双侧翼外肌痉挛（E错）表现为疼痛和开口受限，检查时可见开口中度受限，被动开口度大于自然开口度，在翼外肌相应面部有压痛，一般无自发痛。